治疗支气管哮喘的药物包括
A. 右美沙芬
B. 氯化铵
C. 色甘酸钠
D. 氨茶碱
E. 溴乙胺

正确答案：C、D。色甘酸钠；氨茶碱

解析：本题考查治疗支气管哮喘药物。控制哮喘药物：1.支气管扩张药：①β₂受体激动剂，如沙丁胺醇、特布他林；②茶碱类，如氨茶碱（D对）、二羟丙茶碱、多索茶碱等；③M胆碱受体阻断剂，如异丙托溴铵、噻托溴铵。2.糖皮质激素，如布地奈德、氟替卡松等。3.抗过敏平喘药：①过敏介质阻释药，如色甘酸钠（C对）、酮替芬等；②抗白三烯药，如孟鲁司特等。右美沙芬（A错）是镇咳药。氯化铵（B错）是祛痰药。